下面哪项是球菌性口炎的治疗方法
A. 注射干扰素或转移因子，口服止痛药物
B. 口服酮康唑：成人剂量为每日一次口服200mg，2～4周一个疗程
C. 注射链霉素每日0.5g，或异烟肼每日0.1g局部封闭，每日或隔日一次
D. 每6小时1次或0.2%氯已定漱口液含漱1分钟
E. 全身使用肾上腺皮质激素

正确答案：D。每6小时1次或0.2%氯已定漱口液含漱1分钟

解析：①控制感染：感染程度较严重或伴有全身感染症状者应尽量做细菌学检查和药敏试验，根据药敏试验结果选择具有针对性的抗菌药物。根据不同的感染类型、病情轻重程度、微生物检查结果、宿主的易感性等情况选择用药方式、用药剂量及疗程。②补充维生素：维生素B110mg、维生素B25mg、维生素C100mg，每日3次。③中药治疗：可选有清热解毒作用的药物，如银翘散、导赤散、清胃散和清瘟败毒饮等。若有口渴思饮、心烦便秘、小便黄少等心脾积热症状，可口服口炎宁颗粒剂，每次1～2包。④局部治疗：聚维酮碘漱口液含漱15秒钟，每6小时1次或0.2%氯已定漱口液含漱1分钟，每6小时1次。西地碘片1.5mg含化，每天4～6次，可具有广谱杀菌收敛作用；溶菌酶片20mg含化，每天4～6次，有抗菌抗病毒作用；地喹氯铵含片0.5mg含化，每天4～6次，有抗菌、收敛、止痛作用。掌握“球菌性口炎”知识点。